（对照组罹患率－疫苗接种组罹患率）/对照组罹患率
A. 发病率
B. 相对危险度
C. 效果指数
D. 保护率
E. 都不是

正确答案：D。保护率

解析：本题考查保护率。（对照组罹患率－疫苗接种组罹患率）/对照组罹患率＝保护率（D对ABCE错）。